产生高镁血症最重要的原因是
A. 肾脏排镁障碍
B. 摄镁过多
C. PTH分泌增多
D. 醛固酮分泌增多症
E. 饮食中钙含量增加

正确答案：A。肾脏排镁障碍

解析：肾衰竭、严重脱水、肾上腺皮质功能减退等情况下肾排镁减少（A对），是高镁血症的主要原因。摄镁过多（B错）、PTH分泌增多（C错）、、饮食中钙含量增加（E错）都可引起高镁血症，但不是最重要的原因。醛固酮分泌增多症（D错）时肾排镁增多，可引起低镁血症。